味甘性寒，既治燥热便秘，又治肺热声哑的药是
A. 胖大海
B. 冬葵子
C. 马兜铃
D. 车前子
E. 苦杏仁

正确答案：A。胖大海

解析：本题考查的是胖大海的主治病证。味甘性寒，既治燥热便秘，又治肺热声哑的药是胖大海（A对）。胖大海：【主治病证】（1）肺热声哑，痰热咳嗽。（2）燥热便秘，肠热便血。冬葵子（B错）：【主治病证】（1）湿热淋证，水肿。（2）乳汁不下，乳房胀痛。（3）肠燥便秘。马兜铃（C错）：【主治病证】（1）肺热咳嗽。（2）肺虚有热之咳喘或痰中带血。（3）痔疮肿痛、出血。车前子（D错）：【主治病证】（1）湿热淋证，小便不利，水肿兼热。（2）暑湿水泻。（3）肝热目赤肿痛，肝肾亏虚之目暗不明（配补肝肾药）。（4）肺热咳嗽痰多。苦杏仁（E错）：【主治病证】（1）咳嗽气喘。（2）肠燥便秘。